在高分子囊材（如明胶）溶液中加入凝聚剂，使囊材溶解度降低而凝聚并包裹药物成囊的方法
A. 单凝聚法
B. 复凝聚法
C. 溶剂-非溶剂法
D. 改变温度法
E. 液中干燥法

正确答案：A。单凝聚法